城市大气中铅污染的主要来源是
A. 铅矿开采
B. 汽车尾气排放
C. 钢铁冶炼厂排放
D. 印刷厂排放
E. 以上都不是

正确答案：B。汽车尾气排放

解析：本题考查城市大气中铅污染的主要来源。城市大气中铅污染的主要来源是含铅汽油的使用，即汽车尾气排放（B对ACDE错）。